男，59岁。2型糖尿病病史7年，口服格列本脲15mg/d和二甲双胍2.0g/d治疗。8个月前眼底检查可见微血管瘤、出血和硬性渗出。近1个月来视力明显减退，眼底检查可见视网膜新生血管形成和玻璃体积血。BP160/100mmHg，BMI28.4空腹血糖7.1mmmol/L，餐后2小时血糖14.6mmol/L，糖化血红蛋白7.6%。对该患者糖尿病的治疗应调整为
A. 格列本脲加量
B. 改用胰岛素
C. 二甲双胍加量
D. 加用噻唑烷二酮类药
E. 加用α葡萄糖苷酶抑制剂

正确答案：B。改用胰岛素

解析：中老年男性患者，2型糖尿病7年病史，近一个月来视力明显减退，眼底检查可见视网膜新生血管形成和玻璃体积血，依据2002年国际临床分级标准，本例患者眼底检查符合糖尿病视网膜病变Ⅳ期，糖尿病视网膜病变属于糖尿病微血管病变，为糖尿病特异性慢性并发症。糖尿病出现慢性并发症时，应改用胰岛素治疗（B对）。患者联合应用口服降糖药物最大量依然不能使血糖达标，且已发生微血管并发症，说明患者胰岛功能已严重受损，必须改用胰岛素治疗。并且患者格列本脲（P737）和二甲双胍服用量均已达到最大剂量，不能再加用格列本脲（A错）和二甲双胍（C错）。加用噻唑烷二酮类药（D错）、α葡萄糖苷酶抑制剂（E错）亦不能有效降低血糖。